关于应激性溃疡的描述，不正确的是
A. 多发生于胃，也可累及食管
B. 一般表现胃黏膜水肿、充血、糜烂、溃疡，却不会穿透胃壁全层
C. 最明显的症状是呕血、柏油样便
D. 可发生大出血
E. 可发生于十二指肠

正确答案：B。一般表现胃黏膜水肿、充血、糜烂、溃疡，却不会穿透胃壁全层

解析：应激性溃疡是指在严重创伤、手术、多器官功能衰竭、败血症、精神紧张等应激状态下消化道出现急性糜烂和溃疡，多发生于胃，也可累及食管或十二指肠（AE对），常表现为腹痛、胀满、恶心、呕吐和食欲不振，可穿透胃壁全层（B错，为本题正确答案），最明显的症状是呕血、柏油样便（C对），病情严重者可出现大出血（D对）。